可特异地抑制肾素血管紧张素转化酶的药物
A. 可乐定
B. 美加明
C. 利血平
D. 卡托普利
E. 氢氯噻嗪

正确答案：D。卡托普利

解析：本题考查卡托普利。卡托普利（D对）降低血压作用为抑制血管紧张素转换酶的活性，抑制血管紧张素Ⅰ转换成血管紧张素Ⅱ；作用于缓激肽系统，抑制缓激肽降解，从而扩张血管，降低血压。可乐定（A错）为中枢α₂受体激动剂。美加明（B错）为神经节阻断药，属于非去极化竞争性拮抗剂。利血平（C错）是肾上腺素能神经元阻断性抗高血压药。氢氯噻嗪（E错）为噻嗪类利尿药。